医疗机构调剂部门应实行专用处方，专用账册，专册登记，专柜加锁，专人负责管理的药品是
A. 麻醉药品
B. 第一类精神药品
C. 第二类精神药品
D. 贵重药品
E. 高危药品

正确答案：A、B。麻醉药品；第一类精神药品

解析：本题考查药品管理。麻醉药品（A对）和第一类精神药品（B对）不得零售，实行“五专管理”即专用处方、专用账册，专册登记，专柜加锁，专人负责。第二类精神药品（C错）购入应双人验收，在库房设置相对固定的位置，出账入账要有凭据。贵重药品（D错）应对其购进、保存与售出进行完整记录。高危药品（E错）应在专柜和专区集中存放，有醒目的警示标示。